一患者，在进食数小时内出现呕吐腹泻腹痛，应考虑的疾病是
A. 急性细菌性痢疾
B. 病毒性肠炎
C. 食物中毒
D. 急性胰腺炎
E. 局限性肠炎

正确答案：C。食物中毒

解析：患者在进食数小时内出现呕吐腹泻腹痛，显然为食物中毒（C对）。急性细菌性痢疾表现为发热，腹痛腹胀，脓血便，里急后重等（A错）。病毒性肠炎大多表现为起病急，恶心呕吐，腹痛腹泻等，全身不适，发热（B错）。急性胰腺炎大多表现为急性腹痛多位于中左或全腹，初期可伴有恶心呕吐，轻度发热等（D错）。局限性肠炎又叫克罗恩病，表现多为右下腹或肚脐周腹痛，腹泻，腹部包块等（E错）。